女，53岁。近1年来怕脏，不敢倒垃圾和上厕所。在街上遇到垃圾车也害怕，会反复洗手。自己知道不应该，但不能控制，为此感到苦恼而就诊。最宜联合使用的治疗方法是
A. 经颅磁刺激治疗
B. 口服丙戊酸钠
C. 电抽搐治疗
D. 认知行为治疗
E. 家庭治疗

正确答案：D。认知行为治疗

解析：患者根据典型的强迫观念和强迫行为，已明确诊断为强迫障碍。根据强迫症患者的症状不同，有学者将OCD分为三个亚型，即对称/收藏型，污染/检查型和纯强迫观念型，结合患者表现，该患者为典型的污染/检查型症状。污染/检查型对行为治疗效果好，对称/收藏型患者药物治疗有一定效果，行为治疗效果较差，纯强迫观念型药物治疗效果好，所以该患者最宜联合的治疗为认知行为治疗（D对）。经颅磁刺激治疗（A错）、口服丙戊酸钠（B错）、电抽搐治疗（C错）、家庭治疗（E错）均不是对该患者的最宜联合治疗方法。而经颅磁刺激治疗（A错）和电抽搐治疗（C错）的都只在部分患者中可能有效。丙戊酸钠（B错）是常用的抗癫痫药。家庭治疗（E错）是指以家庭为单位的治疗，以核心家族为干预目标，本题的干预目标是患者本人。